弥漫性膜性增生性肾小球肾炎时，增生的细胞主要是
A. 肾小球脏层细胞和中性粒细胞
B. 肾小球壁层细胞和系膜细胞
C. 肾小球系膜细胞和基质
D. 肾小球毛细血管基底膜增厚和系膜细胞增生
E. 肾小球各种细胞均有较明显增生

正确答案：D。肾小球毛细血管基底膜增厚和系膜细胞增生

解析：弥漫性膜性增生性肾小球肾炎的组织学特点是肾小球基膜增厚、肾小球细胞增生和系膜基质增多，系膜细胞也伴有明显的增生（D对AE错）。肾小球壁层细胞增生多见于急进性肾小球肾炎（B错）。肾小球系膜细胞和基质增多见于膜增生性肾小球肾炎（C错）。